患儿，女，8个月。因腹泻脱水，测血钠135mmol/L。最适宜补充累积丢失量的液体是
A. 0.9％氯化钠溶液
B. 2份生理盐水、1份1.4％碳酸氢钠
C. 2份生理盐水、3份5％葡萄糖、1份1.4％碳酸氢钠
D. 4份生理盐水、3份5％葡萄糖、2份1.4％碳酸氢钠
E. 1份生理盐水、4份5％葡萄糖并含10％氯化钾

正确答案：C。2份生理盐水、3份5％葡萄糖、1份1.4％碳酸氢钠

解析：患儿，女，8个月。因腹泻脱水，测血钠135mmol/L（血清钠在130～150mmol/L为等渗性脱水），该患儿的诊断为等渗性脱水。一般来说，对低渗性脱水补2/3张含钠液，等渗性脱水补1/2张含钠液，高渗性脱水补1/5～1/3张含钠液（P52）。2份生理盐水、3份5％葡萄糖、1份1.4％碳酸氢钠为1/2张溶液，用于等渗性脱水的腹泻补液治疗（C对）。0.9％氯化钠溶液（A错）为等张溶液，2份生理盐水、1份1.4％碳酸氢钠（B错）为2:1等张含钠溶液，二者均用于治疗小儿腹泻扩容阶段的补液治疗（P232）。4份生理盐水、3份5％葡萄糖、2份1.4％碳酸氢钠（D错）为2/3张溶液，可用于低渗性脱水的腹泻补液治疗。1份生理盐水、4份5％葡萄糖并含10％氯化钾（E错）为1/5张溶液可用于高渗性脱水伴低钾血症的腹泻补液治疗。